保存断肢最好的方法是
A. 浸泡于生理盐水中
B. 浸泡于抗生素溶液中
C. 浸泡于新洁尔灭溶液中
D. 包装于口袋内干燥冷藏
E. 置于冰块内

正确答案：D。包装于口袋内干燥冷藏

解析：保存断肢最好的方法是包装于口袋内干燥冷藏（D对）。不能将断肢浸泡于生理盐水（A错）、抗生素溶液（B错）、新洁尔灭溶液（C错）等溶液中，以防组织细胞坏死，失去再植机会。也不能将断肢（指）直接置于冰块内，以防冻伤（E错）。